抛射剂应具备的条件有
A. 为适宜的低沸点液体，常温下蒸汽压应大于大气压
B. 无毒性、无致敏性和刺激性
C. 不与药物、附加剂发生反应
D. 不易燃、不易爆
E. 无色、无味、无臭

正确答案：A、B、C、D、E。为适宜的低沸点液体，常温下蒸汽压应大于大气压；无毒性、无致敏性和刺激性；不与药物、附加剂发生反应；不易燃、不易爆；无色、无味、无臭

解析：本题考查气雾剂的抛射剂。对抛射剂的要求是：①在常温下的蒸气压力大于大气压（A对）；②无毒、无致敏反应和刺激性（B对）；③惰性，不与药物发生反应（C对）；④不易燃、不易爆（D对）；⑤无色、无臭、无味（E对）；⑥价廉易得。